提高人群肺癌筛查检出率的首选方法是
A. 痰细胞学检查
B. PET-CT
C. 低剂量CT
D. 高分辨CT
E. 血清肿瘤标志物

正确答案：C。低剂量CT

解析：胸部CT图像避免了病变与正常组织互相重叠，可发现一般X线检查隐藏区的病变（如肺尖、脊柱旁、心脏后、纵膈等处）。因其薄层扫描，密度分辨率很高，可以显示直径更小，密度更低的病变。CT不但可以显示病灶的局部影像特征，还可以评估肿瘤范围、肿瘤与邻近器官关系、淋巴结转移状况，为制订肺癌的治疗方案提供重要依据，也是发现早期肺癌的最有效手段。以往常规筛查方法为胸片，但是2011年8月新英格兰医学杂志发表的大规模低剂量CT（LDCT）对比胸片筛查肺癌的随机对照研究结果表明，对高危人群用LDCT筛查肺癌可较胸片降低20%的肺癌死亡率（C对）（第14版实用内科学P1760）。高分辨率CT（D错）主要用于支气管扩张和间质性肺疾病等的诊断。血清肿瘤标志物（A错）、痰细胞学检查（E错）只能作为辅助诊断。PET-CT（B错）的适应证包括：肺结节的鉴别诊断、肺癌分期、转移灶检测、疗效评价、肿瘤复发转移监测等。